可认为有甲基汞吸收的检测结果是
A. 头发中总汞值超过35μg/g，其中甲基汞值超过10μg/g
B. 头发中总汞值超过30μg/g，其中甲基汞值超过5μg/g
C. 头发中总汞值超过20μg/g，其中甲基汞值超过15μg/g
D. 头发中总汞值超过15μg/g，其中甲基汞值超过10μg/g
E. 头发中总汞值超过10μg/g，其中甲基汞值超过5μg/g

正确答案：E。头发中总汞值超过10μg/g，其中甲基汞值超过5μg/g

解析：本题考查可认为有甲基汞吸收的检测结果。头发中总汞值超过l0μg/g，其中甲基汞值超过5μg/g者（E对ABCD错），即可认为有甲基汞吸收”。